对脑神经
A. V
B. Ⅶ
C. Ⅸ
D. X
E. Ⅺ

正确答案：D。X

解析：迷走神经（第X对脑神经）（D对）进入腹部后，发出胃前支和胃后支，分布于胃前、后壁。三叉神经（第V对脑神经）（A错）分布于头面部及口鼻腔等。面神经（第VII对脑神经）（B错）分布于头面部等。舌咽神经（第IX对脑神经）（C错）分布于咽、舌后1/3等。副神经（第XI对脑神经）（E错）分布于颈部、咽喉等。